第三代喹诺酮类药物的抗菌机制是其抑制了细菌的
A. 蛋白质合成
B. 细胞壁合成
C. DNA螺旋酶
D. 二氢叶酸还原酶
E. 二氢叶酸合成酶

正确答案：C。DNA螺旋酶

解析：喹诺酮类药物的抗菌机制主要是抑制DNA回旋酶（DNA螺旋）（C对）而阻碍细菌DNA合成而最终导致细菌死亡。喹诺酮类抗生素和其他抗菌药的作用点不同，它们以细菌的脱氧核糖核酸（DNA）为靶，细菌的双股DNA扭曲成为袢状或螺旋状，使DNA形成超螺旋的酶是DNA回旋酶（DNA螺旋酶），喹诺酮类就是妨碍此种酶，进一步造成细菌DNA的不可逆损害，使细菌细胞不再分裂，达到抑菌作用。抑制细菌蛋白质合成（A错）的抗菌药主要包括氨基糖苷类、大环内酯类、林可霉素类、氯霉素类、四环素类。抑制细菌细胞壁合成（B错）的抗生素主要是β-内酰胺类抗生素（青霉素类、头孢菌素类等），还包括多肽类抗生素（万古霉素、去甲万古霉素等）。抑制细菌二氢叶酸还原酶（D错）主要是甲氨蝶呤等抗肿瘤药物。抑制细菌二氢叶酸合成酶（E错）主要是磺胺类抗菌药。